关于预防性树脂充填的范围与使用材料不同，正确的选择是
A. 类型A，最小号圆钻去腐，使用不含填料的封闭剂
B. 类型B，中号或者大圆钻去腐，使用流动树脂
C. 类型C，小号或中号圆钻去腐，使用垫底+复合树脂
D. 类型B，小号或中号圆钻去腐，使用垫底+复合树脂
E. 类型A，中号或者大圆钻去腐，使用流动树脂

正确答案：A。类型A，最小号圆钻去腐，使用不含填料的封闭剂

解析：基于龋损范围、深度和使用的充填材料，可将预防性树脂充填分为3种类型：类型A，需用最小号圆钻去除脱矿牙釉质，用不含填料的封闭剂充填。类型B，用小号或中号圆钻去除龋损组织，洞深基本在牙釉质内，通常用流动树脂材料充填。类型C，用中号或较大圆钻去除龋坏组织，洞深已达牙本质需垫底，涂布牙本质或牙釉质黏结剂后用后牙复合树脂材料充填。掌握“预防性树脂充填”知识点。